成人颏孔多朝向
A. 后、上、外方
B. 后、上、内方
C. 后、下、内方
D. 前、下、内方
E. 后、下、外方

正确答案：A。后、上、外方

解析：下颌体外面上下缘之间略偏上方处有颏孔，其方向出生时直接朝前，出生2～3岁朝向后上，成人颏孔多朝向后、上、外方。掌握“面部表面解剖”知识点。